指导合理用药时，应告知患者服药后多饮水的药物有
A. 复方磺胺甲噁唑片
B. 复方甘草片
C. 硝酸异山梨酯片
D. 磷酸铝凝胶
E. 阿昔洛韦片

正确答案：A、E。复方磺胺甲噁唑片；阿昔洛韦片

解析：本题考查服用后宜多饮水的药物。指导合理用药时，应告知患者服药后多饮水的药物有复方磺胺甲噁唑片（A对）、阿昔洛韦片（E对）。阿昔洛韦可形成尿道结石或肾结石，所以在治疗期间应确保足够的水化。复方磺胺甲噁唑时宜大量饮水，也可加服碳酸氢钠以碱化尿液，减少析晶对尿道的伤害。服用甘草合剂（B错）时应限制饮水，避免将药物冲掉。磷酸铝凝胶（D错）需要直接嚼碎吞服，应限制饮水。硝酸甘油片（C错）也应限制饮水。